注射剂污染热原的主要途径有
A. 注射用溶剂
B. 原料、辅料
C. 容器与设备
D. 生产过程、环境及操作人员
E. 输液器具

正确答案：A、B、C、D、E。注射用溶剂；原料、辅料；容器与设备；生产过程、环境及操作人员；输液器具

解析：本题考查的是注射剂污染热原的途径。注射剂污染热原的主要途径有注射用溶剂（A对）、原料、辅料（B对）、容器与设备（C对）、生产过程、环境及操作人员（D对）与输液器具（E对）。注射剂污染热原的途径：（1）溶剂：是热原污染的主要途径。若蒸馏设备结构不合理、操作或贮存不当均易被热原污染。（2）原辅料：原辅料本身质量不佳，贮藏时间过长或包装不符合要求甚至破损，均能受到微生物污染而产生热原。以中药为原料的制剂，原料中带有大量的微生物，提取处理的条件不当也容易产生热原。（3）容器、用具、管道与设备：注射剂制备时所用的用具、管道、装置、灌装注射剂的容器等接触药液的一切器具，使用前清洗不彻底或灭菌不完全，均可污染热原。（4）制备过程：制备过程中环境的洁净级别达不到规定要求、工作人员未严格执行操作规程、或操作时间过长、灭菌不及时或灭菌不彻底、包装不严密等，都可能使注射剂污染热原。（5）临床应用过程：多数由于临床使用注射器具（输液瓶、乳胶管、针头与针筒等）的污染所致。